肺的功能是
A. 生气
B. 纳气
C. 主气
D. 载气
E. 行气

正确答案：C。主气

解析：本题考查的是肺的生理功能。肺的功能是主气（C对）。肺的生理功能，包括肺主气、司呼吸，主宣发肃降，通调水道，朝百脉而主治节。生气（A错）和载气（D错）为血的生理功能。血为气之母，是指血是气的载体，并给气以充分的营养，概括为血能载气和血能生气。纳气（B错）为肾的生理功能。肾的生理功能主要有三方面：一是藏精，主生长、发育与生殖；二是主水；三是主纳气。行气（E错）与脏腑、经络、形体、官窍的功能活动有关。气的运行，称作“气机”，“升降出入”是气运动的基本形式。气的升降出入运动体现在脏腑、经络、形体、官窍的功能活动中。例如，肺主呼吸，有出有入，有宣有降，肺主呼气（出）、肾主纳气（入），心火下降、肾水升腾，以及脾主升清、胃主降浊等。